下述生产性毒物中，属于窒息性气体的是
A. 氢氰酸
B. 氯气
C. 氯乙烯
D. 一氧化氮
E. 苯

正确答案：A。氢氰酸

解析：窒息性气体属于职业性有害因素：一氧化碳、氢氰酸（A对）、硫化氢、甲烷。氯气（B错）、氯乙烯（C错）、一氧化氮（D错）属于刺激性气体。苯（E错）属于有机溶剂类的毒物，可通过呼吸道吸入，但主要中毒机制不是使人窒息。